治疗肝性脑病时，可以促进氨代谢的药物是
A. 新霉素
B. 支链氨基酸
C. 乳果糖
D. 氟马西尼
E. L-鸟氨酸-L-天冬氨酸

正确答案：E。L-鸟氨酸-L-天冬氨酸

解析：治疗肝性脑病时，促进氨代谢的药物包括L-鸟氨酸-L-天冬氨酸（E对）、鸟氨酸-α-酮戊二酸、谷氨酸钠或钾、精氨酸等。新霉素（A错）通过抑制肠道细菌，减少氨的生成；乳果糖（C错）可以减少肠内氨的产生和吸收，并促使血液中的氨渗入肠道排出体外；两者属于减少肠内氮源性毒物的生成与吸收类药物。支链氨基酸（B错）和氟马西尼（D错）属于调节神经递质类药物。